《中国药典》规定，低温干燥的温度一般不超过
A. 30℃
B. 40℃
C. 50℃
D. 60℃
E. 70℃

正确答案：D。60℃

解析：本题考查的是药材产地加工的干燥方法。《中国药典》规定，低温干燥的温度一般不超过60℃（D对）。药材产地加工的干燥方法：除少数药材，如石斛、鱼腥草、地黄、益母草等，有时要求鲜用外，大多数药材经加工后均应及时干燥。干燥的目的是除去新鲜药材中的大量水分，避免发霉、变色、虫蛀以及有效成分的分解和破坏，保证药材质量，利于贮藏。《中国药典》规定药材产地加工的干燥方法如下。（1）烘干、晒干、阴干均可的，用“干燥”表示。（2）不宜用较高温度烘干的，则用“晒干”或“低温干燥”（一般不超过60℃）表示。（3）烘干、晒干均不适宜的，用“阴干”或“晾干”表示。（4）少数药材需要短时间干燥，则用“曝晒”或“及时干燥”表示。近年来常使用的还有远红外加热干燥、微波干燥、冷冻干燥等新方法干燥药材。